男性，56岁。食欲减退半年，巩膜轻度黄染，肝肋下及边。血红蛋白80g/L，红细胞3.1✕10¹²/L，网织红细胞2%。骨髓象示幼红细胞增生活跃，中、晚幼红细胞为主，幼红细胞体积小，胞质少、边缘不整，粒细胞系及巨核细胞系正常。关于缺铁性贫血的描述，正确的是
A. 目的是使血红细胞蛋白恢复正常
B. 维生素B₁₂可增强疗效
C. 多饮茶水
D. 小剂量开始，血红蛋白正常后再用药2﹣3个月
E. 禁用酸性药物

正确答案：D。小剂量开始，血红蛋白正常后再用药2﹣3个月